血尿伴剧烈腹痛最常见于
A. 肾炎
B. 膀胱结核
C. 肾肿瘤
D. 泌尿系结石
E. 过敏性紫癜

正确答案：D。泌尿系结石

解析：血尿伴剧烈腹痛是肾或输尿管结石的特征，故最常见于泌尿系结石（D对）。肾炎（A错）表现为血尿伴有水肿、高血压、蛋白尿等。膀胱结核（B错）表现为血尿伴尿频、尿急、尿痛、脓尿等。肾肿瘤（C错）表现为血尿伴有腹部肿块等。过敏性紫癜（E错）表现为血尿伴有皮肤黏膜出血点等。